无线电波中频率最大的部分是
A. 紫外线
B. 红外线
C. 高频电磁场
D. 无线电波
E. 微波

正确答案：E。微波